病例对照研究的推断性统计主要检验
A. 病例和对照的年龄、性别分布
B. 均衡性检验
C. 病例组与对照组的暴露率差异
D. 相对危险度
E. 归因危险度

正确答案：C。病例组与对照组的暴露率差异

解析：本题考查病例对照研究的推断性统计。病例对照研究的推断性统计通过比较病例组与对照组对某些研究因素暴露率的差异（C对ABDE错），分析暴露与疾病有无关联，如果暴露与疾病有关联，则进一步分析关联的强度。